银在银汞合金中的作用下列哪一条是错误的
A. 易与汞结合
B. 是银汞合金强度的主要成分
C. 可使银汞合金体积膨胀
D. 可减少银汞合金的流动性

正确答案：A。易与汞结合

解析：本题考查银在银汞合金中的作用。银在银汞合金中的作用错误的是易与汞结合（A错，为本题的正确答案）。银在银汞合金中的作用有，低铜银合金粉中，银是形成银汞合金的主体成分（B对），是银汞合金强度的主要贡献者。但是纯银难于与汞发生汞齐化反应进而结合，而锡与汞具有较大的亲和力，锡与银形成的合金粉容易与汞发生汞齐化反应。银含量增加，可使银汞合金体积膨胀（C对）。银具有增强银汞合金强度的作用，因此银可减少银汞合金的流动性（D对），增强其强度。